专攻涂抹敷于皮肤的外用液体制剂的是
A. 洗剂
B. 搽剂
C. 洗漱剂
D. 灌洗剂
E. 涂剂

正确答案：A。洗剂

解析：本题考查洗剂。洗剂（A对）系指供清洗或涂抹无破损皮肤或腔道用的液体制剂；搽剂（B错）为供无破损皮肤揉擦用的液体制剂；洗漱剂（C错）是指专供洗漱用的液体制剂；灌洗剂（D错）分护理保健类洗液和阴道灌洗清洁液两类；涂剂（E错）是指用纱布或棉球蘸取涂于皮肤或口腔与喉部黏膜的液体制剂。